消费者和经营者发生消费权益争议的解决途径中，不包括
A. 请求消费者协会组织调解
B. 与经营者协商和解
C. 向有关行政部门申请行政裁决
D. 向人民法院提起诉讼

正确答案：C。向有关行政部门申请行政裁决

解析：本题考查消费者和经营者争议的解决。消费者和经营者发生消费权益争议的解决途径中，不包括向有关行政部门申请行政裁决（C错，为本题正确答案）。《中华人民共和国消费者权益保护法》第六章争议的解决第三十九条：消费者和经营者发生消费者权益争议的，可以通过下列途径解决：（一）与经营者协商和解（B对）；（二）请求消费者协会或者依法成立的其他调解组织调解（A对）；（三）向有关行政部门投诉；（四）根据与经营者达成的仲裁协议提请仲裁机构仲裁；（五）向人民法院提起诉讼（D对）。